甲状腺功能亢进引起发热主要是因为
A. 坏死物质吸收
B. 自主神经功能紊乱
C. 产热过多
D. 散热过少
E. 抗原-抗体反应

正确答案：C。产热过多

解析：甲亢可引起低热，是因为甲状腺激素能导致人体产热过程增加，所以甲亢患者会出现低热，体温一般波动在37-37.5℃之间（C对）。